某患者，全身肌紧张增高，随意运动减少，动作缓慢，面部表情呆板。临床诊断为震颤麻痹。其病变主要位于
A. 黑质
B. 红核
C. 小脑
D. 纹状体
E. 苍白球

正确答案：A。黑质